不存在于人体蛋白质分子中的氨基酸是
A. 鸟氨酸
B. 丙氨酸
C. 亮氨酸
D. 谷氨酸
E. 甘氨酸

正确答案：A。鸟氨酸

解析：鸟氨酸（A对）在体内主要参与鸟氨酸循环，不参与天然蛋白质合成。人体内所有蛋白质都是由下面这20种氨基酸组成的：甘氨酸（E错）、丙氨酸（B错）、缬氨酸、亮氨酸（C错）、异亮氨酸、脯氨酸、丝氨酸、半胱氨酸、蛋氨酸、天冬酰胺、谷氨酰胺、苏氨酸、苯丙氨酸、色氨酸、酪氨酸、天冬氨酸、谷氨酸（D错）、赖氨酸、精氨酸、组氨酸。